急性下壁心肌梗死最易合并
A. 室性早搏
B. 房室传导阻滞
C. 心房颤动
D. 房性心动过速
E. 右束支传导阻滞

正确答案：B。房室传导阻滞

解析：一般情况下，右冠状动脉发出房室结支支配房室结。当右冠状动脉阻塞时，除导致急性下壁心肌梗死外，常导致房室结缺血，引起房室结及房室束缺血、水肿及炎症，极易造成房室传导阻滞，因此急性下壁心肌梗死最易合并房室传导阻滞（B对）。前壁心肌梗死易发生室性心律失常，其中以室性早搏最多见（A错）。心房颤动（C错）、房性心动过速（D错）、右束支传导阻滞（E错）少见于心肌梗死患者。